女，35岁。乏力、面色苍白1月余。血常规：Hb86g/L，WBC3.6×10⁹/L，Plt360×10⁹/L，MCV72fl，MCHC28%，Ret0.014，给予口服铁剂治疗1周时可出现的血液指标变化是
A. MCHC上升
B. Plt上升
C. RBC上升
D. WBC上升
E. Ret上升

正确答案：E。Ret上升

解析：患者青年女性，乏力、面色苍白1月余（贫血表现）。血常规示Hb86g/L（＜90g/L，中度贫血），MCV72fl（＜80fl），MCHC28%（＜32%），Ret0.014（正常0.005～0.015）。结合患者临床表现及实验室检查，最可能的诊断是缺铁性贫血。用铁剂治疗失血过多或需铁增加所致的缺铁性贫血，疗效极佳，用药后一般症状及食欲迅速改善，外周网织红细胞（Ret）（E对）首先增加，于开始服药后5～10天达到高峰，2周后血红蛋白浓度上升，一般2个月左右恢复正常。